某女，42岁。经血淋漓不断月余，气短懒言，倦怠乏力，面色苍白。舌淡，脉细弱无力。治宜选用的中成药是
A. 少腹逐瘀丸
B. 安坤赞育丸
C. 宫血宁胶囊
D. 乌鸡白凤丸
E. 人参健脾丸

正确答案：D。乌鸡白凤丸

解析：本题考查的是崩漏的辨证论治。经血淋漓不断月余，气短懒言，倦怠乏力，面色苍白。舌淡，脉细弱无力。治宜选用的中成药是乌鸡白凤丸（D对）。崩漏是月经的周期、经期、经量发生严重失常的病证，经血非时暴下不止或不尽，前者谓之崩中，后者谓之漏下。崩与漏出血情况虽不同，然二者常相互转化，交替出现，且其病因病机基本相同，故概称崩漏。西医学中的无排卵性功能性子宫出血，可参照本证进行辨证治疗。（一）气血两虚证：【症状】出血量多或淋沥不尽，血色淡薄，面色无华，气短懒言，食欲不振，便溏。舌质淡，苔薄白湿润，脉细弱。【中成药应用】常用中成药有定坤丹、乌鸡白凤丸、养血饮口服液。（二）脾不统血证：【症状】出血量多，日久而止，气短神疲，面色㿠白，或面浮肢肿，手足不温，或饮食不佳，大便溏。舌质淡，苔薄白，脉弱或沉弱。【中成药应用】常用中成药有人参归脾丸（E错）、阿胶三宝膏、山东阿胶膏。（三）肝肾不足证：【症状】月经非时而下，或月经先期，经期延长，经血暗红，量少而淋沥不畅，咽干颧红，心烦潮热，腰膝酸软。舌红苔少或光剥苔，脉沉细无力。【中成药应用】常用中成药有妇科止血灵片、安坤赞育丸（B错）、春血安胶囊。（四）瘀血阻络证：【症状】经血非时而下，量时多时少，时出时止，或淋沥不断，或停闭数月又突然崩中，继之漏下，经色暗有血块；舌质紫暗或尖边有瘀点，脉弦细或涩。【中成药应用】常用中成药有宫血停颗粒、四物胶囊、茜芷胶囊。少腹逐瘀丸（A错）为痛经寒凝血瘀证的中成药应用。痛经寒凝血瘀证：【症状】经行小腹冷痛，得热则舒，经量少，色紫暗有块；形寒肢冷小便清长。脉细或沉紧。【中成药应用】常用中成药有温经丸、少腹逐瘀丸、妇科万应膏。宫血宁胶囊（C错）为月经过多血热证的中成药应用。月经过多血热证：【症状】经行量多，经色鲜红或深红，有光泽，质稠黏；伴心烦口渴，身热面赤，大便干结，小便黄赤，或有灼热感。舌红绛，苔黄，脉滑数。【中成药应用】常用中成药有宫血宁胶囊、断血流片、止血灵胶囊。